对流感的预防措施应采取
A. 对传染源采取措施
B. 对易感者采取措施
C. 对传播途径采取措施
D. A+B+C，采取综合性措施
E. 不需采取措施，可自行停止传播

正确答案：D。A+B+C，采取综合性措施